在无菌医用纱布包装上不要求写明的是
A. 灭菌的有效期
B. 出厂日期和生产批号
C. 酸碱性和刺激性数据和说明标识
D. 包装破损禁用说明或标识
E. 一次性使用说明或禁止再次使用标识

正确答案：C。酸碱性和刺激性数据和说明标识